职业卫生基本情况调査的目的是
A. 建立工矿企业职业卫生档案
B. 探究职业性有害因素对职业人群健康的影响
C. 尽快有效地抢救病人
D. 识别职业性有害因素
E. 评价职业性有害因素

正确答案：A。建立工矿企业职业卫生档案